有神经症状的大细胞贫血首选
A. 维生素B₁₂
B. 叶酸
C. 维生素C
D. 铁剂
E. 维生素B₆

正确答案：A。维生素B₁₂

解析：本题考查大细胞贫血的治疗。治疗有神经症状的大细胞贫血首选维生素B₁₂（A对BCDE错），维生素B₁₂会参与人体血液代谢，促进红细胞的发育与成熟，缺乏后容易造成巨幼红细胞性贫血。